带有前噬菌体的细菌称为
A. 温和噬菌体
B. 毒性噬菌体
C. 前噬菌体
D. 溶原性细菌
E. L型细菌

正确答案：D。溶原性细菌

解析：温和噬菌体或称溶原性噬菌体在感染宿主菌后并不增殖，其基因整合于细菌染色体中。结合在细菌染色体上的噬菌体基因称为前噬菌体，该细菌称为溶原性细菌。掌握“噬菌体性状及分类”知识点。